一定时间内某人群死亡人数在该人群中所占的比例为
A. 引入率
B. 续发率
C. 发病率
D. 病死率
E. 累积死亡率

正确答案：E。累积死亡率